乳剂中乳化剂类型改变，最终可导致出现哪种不稳定现象
A. 分层
B. 转相
C. 酸败
D. 絮凝
E. 破裂

正确答案：B。转相

解析：本题考查乳剂。转相是指由于某些条件的变化而改变乳剂类型的现象。由0/W型转变成W/O或发生相反的变化。转相（B对）通常是由于乳化剂性质发生改变引起的，如油酸钠本来为O/W型乳化剂，加入足量的氯化钙，可使乳剂转变成W/O型乳剂。分层（A错）的主要原因是分散相和分散介质之间的密度差。酸败（C错）的主要原因是微生物及光、热、空气等的作用。絮凝（D错）的主要原因是Zeta电位降低。破裂（E错）的主要原因是乳化剂失去乳化作用。